治疗遗尿伴夜梦多，除主穴外，应加
A. 肾俞、内关
B. 肾俞、肺俞
C. 肺俞，足三里
D. 百会、神门
E. 脾俞、内关

正确答案：D。百会、神门

解析：肾俞、内关可治心肾阳虚证（A错）。遗尿除主穴外，肺肾气虚加肺俞、肾俞（B错）。肺脾气虚者加肺俞、脾俞、足三里（C错）。遗尿伴夜梦多加百会、神门（D对）。脾俞、内关可治心脾的虚证（E错）。